颞下颌关节侧斜位片不能显示的组织结构是
A. 关节窝
B. 关节结节
C. 髁状突
D. 喙突
E. 关节间隙

正确答案：D。喙突

解析：本题考查颞下颌关节侧斜位片显示的组织结构。因喙突（D错，为本题的正确答案）位于颞下颌关节内侧，故此片不能显示。颞下颌关节侧斜位片又称许勒位片，因其投照技术此片显示颞下颌关节外侧1/3侧斜位影像，可以同时显示关节窝（A对）、关节结节（B对）、髁状突（C对）及关节间隙（E对）。临床上髁状突骨折、脱位、肿瘤、先天畸形以及颞下颌关节紊乱病常用此片。